男，36岁，自述吃苹果时有牙龈出血，检查发现龈下牙石（+），X线片显示牙周骨组织没有丧失现象，出血部位的上皮最准确的名称为
A. 口腔上皮
B. 结合上皮
C. 被覆黏膜
D. 龈谷上皮
E. 龈沟上皮

正确答案：E。龈沟上皮

解析：本题考查牙龈的组织结构。患者男，36岁，自述吃苹果时有牙龈出血，检查发现龈下牙石（+），X线片显示牙周骨组织没有丧失现象，由于龈沟上皮（E对）不能抵抗机械力，而易破裂，考虑处血的原因可能是龈沟上皮破裂。龈沟上皮是复层鳞状上皮，无角化，有上皮钉突，在龈沟底与结合上皮有明显分界，上皮细胞质少，含少量粗面内质网和许多张力细丝，龈沟上皮丧失其角化是因上皮下结缔组织的炎症引起的。结缔组织的炎症可影响上皮的成熟，如去除这些炎症，龈沟上皮仍可角化。口腔上皮（A错）是构成人体口腔的基本上皮组织，由口腔上皮细胞构成，口腔上皮细胞是扁平、多边形的，形状不规则，主要分布在口腔两侧颊部。结合上皮（B错）是牙龈上皮附着在牙表面的一条带状上皮，无角化，无上皮钉突，从龈沟底开始，项根尖方向附着在牙釉质或牙骨质表面。被覆粘膜（C错）指口腔黏膜中除咀嚼黏膜和舌背黏膜以外者，表面光滑，粉红色，无角化，富有弹性，有一定的活动度。龈谷上皮（D错）表面为薄的未角化上皮，有上皮钉突深入到结缔组织中，龈谷区容易聚集细菌和菌斑而发生龈炎。